下列何肌对髋关节无旋外作用
A. 耻骨肌
B. 缝匠肌
C. 短收肌
D. 大收肌
E. 长收肌

正确答案：B。缝匠肌

解析：缝匠肌（B错，为本题正确答案）屈髋、屈膝关节，使已屈的膝关节旋内，而对髋关节无旋外作用。耻骨肌（A对）、短收肌（C对）、大收肌（D对）和长收肌（E对）使髋关节内收和旋外。